女，62岁。发热，咳嗽，咳脓痰3天，支气管扩张病史20年，近年来曾因感染反复住院治疗，频繁使用广谱抗生素，查体：体温38.5℃，左下肺可闻及湿性啰音，心率90次/分，律齐，患者感染的病原体最可能是
A. 肺炎支原体
B. 肺炎链球菌
C. 铜绿假单胞菌
D. 肺炎克雷伯杆菌
E. 金黄色葡萄球菌

正确答案：E。金黄色葡萄球菌

解析：患者老年女性。发热，咳嗽，咳脓痰3天（脓性痰），支气管扩张病史20年（基础疾病），体温38.5℃（腋下正常温度36℃～37℃），左下肺可闻及湿性啰音。根据病史、临床表现、体征，可诊断为葡萄球菌肺炎（E对）。起病多急骤，寒战、高热，体温多高达39～40℃，胸痛，痰脓性，量多，带血丝或呈脓血状。毒血症状明显，全身肌肉、关节酸痛，体质衰弱，精神萎靡，病情严重者可早期出现周围循环衰竭。院内感染者通常起病较隐袭，体温逐渐上升。老年人症状可不典型。早期可无体征，常与严重的中毒症状和呼吸道症状不平行，然后可出现两肺散在性湿啰音（P48）。肺炎支原体（A错）见于支原体肺炎。肺炎链球菌（B错）见于肺炎链球菌肺炎。铜绿假单胞菌（C错）见于医院获得性肺炎有感染高危因素者。肺炎克雷伯杆菌（D错）见于医院获得性肺炎。